形成牙釉质的细胞为
A. 外釉上皮细胞
B. 内釉上皮细胞
C. 星网状层细胞
D. 中间层细胞
E. 成牙本质细胞

正确答案：B。内釉上皮细胞

解析：内釉上皮细胞形成牙釉质的过程为：内釉上皮细胞→前成釉细胞→成釉细胞→牙釉质。掌握“牙胚的发生及分化”知识点。